《中华人民共和国价格法》规定经营者可以
A. 在政府指导价的幅度内制定价格
B. 以政府指导价为基础，自主规定浮动幅度
C. 为了独占市场，以低于成本的价格销售商品
D. 对具有同等交易条件、提供相同商品的经营者实行不同价格
E. 在商品标价之外，加收1%的咨询服务费

正确答案：A。在政府指导价的幅度内制定价格